单糖的绝对构型是指在Fischer投影式中
A. 距羰基最远的不对称碳原子的构型
B. 距羰基最近的不对称碳原子的构型
C. 2位不对称碳原子的构型
D. 3位不对称碳原子的构型
E. 端基碳原子的构型

正确答案：A。距羰基最远的不对称碳原子的构型

解析：本题考查的是单糖的构型。单糖的绝对构型是指在Fischer投影式中距羰基最远的不对称碳原子的构型（A对）。单糖是多羟基醛或酮，是组成糖类及其衍生物的基本单元。结构可以用Fischer投影式和Haworth投影式表示。习惯上将单糖Fischer投影式中距羰基最远的那个不对称碳原子的构型定为整个糖分子的绝对构型，其羟基向右的为D型，向左的为L型。而Haworth式中则看那个不对称碳原子上的取代基，向上的为D型，向下的为L型，这只限于与最远的不对称碳原子成环者。